患者，女，65岁，体检结果示：低密度脂蛋白胆固醇5.7mmol/L，颈动脉粥样硬化斑块。宜选用的药物是
A. 阿托伐他汀
B. 甲巯咪唑
C. 丙硫氧嘧啶
D. 氢氯噻嗪
E. 碳酸氢钠

正确答案：A。阿托伐他汀

解析：本题考查阿托伐他汀。宜选用的药物是阿托伐他汀（A对）。阿托伐他汀属于羟甲基戊二酰辅酶A还原酶抑制剂，能够使血总胆固醇、低密度脂蛋白和载脂蛋白B水平降低，从而对动脉粥样硬化及冠心病的防治产生作用，还能够稳定和缩小动脉粥样硬化的脂质斑块，减少心血管事件发生。甲巯咪唑（B错）属于硫脲类抗甲状腺药。丙硫氧嘧啶（C错）能抑制过氧化酶系统，使被摄入到甲状腺细胞内的碘化物不能氧化成活性碘，酪氨酸不能碘化；同时，一碘酪氨酸和二碘酪氨酸的缩合过程受阻，以致不能生成甲状腺激素。氢氯噻嗪（D错）为噻嗪类利尿药，长期用药则通过扩张外周血管而产生降压作用。碳酸氢钠（E错）为抗酸药，常用于痛风治疗药服药时期的碱化尿液。